气态毒物引起急性中毒时，将患者转移到空气新鲜处急救，其目的为
A. 便于及时抢救
B. 及时补充新鲜空气
C. 防止急救人员中毒
D. 促进毒物排出
E. 防止继续吸入毒物并促进毒物经肺部排出

正确答案：E。防止继续吸入毒物并促进毒物经肺部排出